患儿，女，7岁，检查发现左下第一乳切牙，Ⅱ°松动，需要拔除，临床常用的麻醉方法是
A. 阻滞麻醉
B. 浸润麻醉
C. 表面麻醉
D. 冷冻麻醉
E. 全身麻醉

正确答案：C。表面麻醉

解析：表面麻醉适用于表浅的黏膜下脓肿切开引流，拔除松动的乳牙或恒牙，以及行气管内插管前的黏膜表面麻醉。掌握“颌面部常用局麻法及牙拔除的麻醉选择”知识点。